用于研究两个连续性变量X和Y之间的线性数量依存关系的是
A. 直线回归
B. 秩和检验
C. 卡方检验
D. Z检验
E. 方差检验

正确答案：A。直线回归

解析：直线回归又称简单回归，用于研究两个连续性变量X和Y之间的线性数量依存关系。掌握“秩和检验、直线回归和线性分析”知识点。